应用后宜用温水或0.9%氯化钠溶液漱口的剂型是
A. 泡腾片剂
B. 舌下片
C. 激素类气雾剂
D. 缓控释制剂
E. 透皮贴剂

正确答案：C。激素类气雾剂

解析：本题考查各种剂型的正确使用。激素类气雾剂（C对）使用后宜用温水或0.9%氯化钠溶液漱口。泡腾片（A错）一般宜用100～150ml凉开水或温水浸泡，可迅速崩解和释放药物，严禁直接服用或口含。舌下片（B错）含服时间一般控制在5min。缓、控释制剂（D错）除另有规定外，一般应整片或整丸吞服。透皮贴剂（E错）应用时需贴敷于干净的皮肤，经皮给药。